颞部外伤出血进行压迫止血的有效部位是
A. 耳屏前区
B. 颈动脉三角区
C. 颌外动脉走行区
D. 下颌角区
E. 咬肌前缘

正确答案：A。耳屏前区

解析：颞浅动脉在耳屏前区可摸到搏动，因此颞部外伤时可以在耳屏前区压迫止血。掌握“口外手术组织切开、止血及组织分离”知识点。